与口角炎发病无关的因素有
A. B族维生素缺乏，致营养不良
B. 感染因素
C. 遗传因素
D. 创伤因素
E. 变态反应

正确答案：C。遗传因素

解析：口角炎的种类较多，分为感染性口角炎（由真菌、细菌、病毒等病原微生物引起）；创伤性口角炎（由口角区医源性创伤、严重的物理刺激或某些不良习惯引起）；接触性口角炎（患者常有过敏体质，一旦接触变应原或毒性物质可引起发病）；营养不良性口角炎（由营养不良引起，尤其是维生素B2缺乏达一年之久者）。掌握“口角炎”知识点。